银柴胡的原植物属于
A. 蓼科
B. 毛茛科
C. 苋科
D. 十字花科
E. 石竹科

正确答案：E。石竹科

解析：本题考查的是银柴胡的来源。银柴胡的原植物属于石竹科（E对）。银柴胡：【来源】为石竹科植物银柴胡的干燥根。来源于蓼科（A错）的中药有大黄、虎杖、何首乌、蓼大青叶等。来源于毛茛科（B错）的中药有威灵仙、川乌、附子、白芍、赤芍、升麻等。来源于苋科（C错）的中药有牛膝、川牛膝等。来源于十字花科（D错）的中药有板蓝根、大青叶、葶苈子、芥子、莱菔子等。